桥体（牙合）面形态应做到
A. 边缘嵴形态要正确恢复
B. 桥体（牙合）面应形成颊沟和舌沟
C. 桥体与固位体之间应形成一定的内、外展隙及邻间隙
D. （牙合）面功能牙尖与对颌牙的接触应均匀
E. 以上各点均应做到

正确答案：E。以上各点均应做到

解析：本题考查桥体形态设计-桥体的（牙合）面设计。桥体（牙合）面形态应根据缺失牙的解剖形态及与对颌牙的咬合关系来恢复，包括边缘嵴形态要正确恢复（A对）、桥体（牙合）面应形成颊沟和舌沟（B对）、（牙合）面功能牙尖与对颌牙的接触应均匀（D对）、恢复（牙合）面食物溢出沟等，这样可以最大限度地恢复患者原有咬合，有利于提高咀嚼效率。另外，桥体与固位体之间还应形成一定的内、外展隙及邻间隙（C对），适当加大桥体与固位体之间的外展隙还可有效减小（牙合）力。（ABCD均对，E为本题的正确答案）。